下列有表里关系的经脉是
A. 手太阴与手少阳
B. 足厥阴与足少阳
C. 手少阴与手阳明
D. 足太阳与足太阴
E. 足少阴与足阳明

正确答案：B。足厥阴与足少阳

解析：十二经脉在体内与脏腑相连属，由于脏腑有表里相合的关系，因此，十二经脉之阴经与阳经亦有明确的脏腑属络和表里关系。阴经属脏络腑，阳经属腑络脏，阴阳配对，这样就在脏腑阴阳经脉之间形成了六组表里属络关系。有手太阴肺经与手阳明大肠经相表里（A错）；足少阳胆经与足厥阴肝经相表里（B对）；手少阴心经与手厥阴心包经相表里（C错）；足太阳膀胱经与足少阴肾经相表里（DE错）。互为表里的经脉在生理上相互联系，病理上相互影响，治疗上相互为用。